分布到眼球角膜的神经是
A. 视神经
B. 动眼神经
C. 滑车神经
D. 眼神经
E. 展神经

正确答案：D。眼神经

解析：分布到眼球角膜的神经是眼神经（D对）。视神经（A错）分布到眼球视网膜。动眼神经（B错）、滑车神经（C错）、展神经（E错）分布到眼外肌，其中动眼神经还分布到瞳孔括约肌、睫状肌。